下颌骨发育基本完成是在胚胎
A. 第五周
B. 第六周
C. 第七周
D. 第八周
E. 第十周

正确答案：E。第十周

解析：胚胎第十周时下颌骨发育基本完成。掌握“唾液腺与颌骨的发育”知识点。